男，60岁，一年来右侧上后牙痛，痛多在傍晚发生，并涉及右眶下部和颞部。患者数年前曾有头痛及流涕史。查：右上5远中（牙合）面和右上6（牙合）面深龋，叩痛（+），扪痛（+），右上7和右上4牙冠完整，叩痛（-），右上8残根。为明确诊断必须做的检查是
A. 牙髓电活力测验
B. 牙髓温度测验
C. 耳鼻喉科会诊
D. X线片检查
E. 松动度检查

正确答案：B。牙髓温度测验

解析：本题考查慢性牙髓炎的诊断。根据病例所述，一年来右侧上后牙痛，痛多在傍晚发生，右上5远中（牙合）面和右上6（牙合）面深龋，叩痛（+），扪痛（+），可知患牙疼痛1年、有深龋、轻度叩痛，表明牙髓有炎症，慢性牙髓炎的疼痛多发生在下午和晚上，因此可考虑患牙为慢性牙髓炎，为进一步确诊需要做牙髓温度测验（B对），以检查患牙对温度的敏感性，若温度测验敏感，则可诊断为慢性牙髓炎。牙髓电活力测验（A错）用来检验牙髓的活力，但不能确诊牙髓的炎症状态。患者虽然数年前曾有头痛及流涕史，但这次就诊时并未诉鼻塞、脓涕、头痛等慢性鼻窦炎的症状，因此暂不考虑慢性鼻窦炎或上颌窦炎方面的疾病，暂不需耳鼻喉科会诊（C错）。X线片检查（D错）可用于观察龋坏范围和根尖骨质情况，该病例中牙髓炎症症状明显，通过X线片观察患牙是否穿髓的意义不大。松动度检查（E错）主要反映患牙的牙周情况，慢性牙髓炎的患牙可有轻微松动或无明显松动，此项检查对于确定慢性牙髓炎这一诊断无明显意义，无需进行。